关于反馈调节不正确的是
A. 负反馈是反馈信号能减低受控部分的活动
B. 负反馈的主要意义维持机体内环境的稳态
C. 正反馈的主要意义是维持机体内环境的稳态
D. 正反馈的主要意义使某些生理过程一旦开始迅速加强直到完成
E. 血液凝固属于正反馈调节

正确答案：C。正反馈的主要意义是维持机体内环境的稳态